临床表现呈多样性，主要表现为血尿、蛋白尿、可伴有水肿、高血压、肾功能不全，病情迁延，肾功能逐步恶化，进入尿毒症的为下列哪项疾病
A. 慢性肾小球肾炎
B. 急性肾小球肾炎
C. 原发性肾病综合征
D. 继发性肾病综合征
E. 肾结核

正确答案：A。慢性肾小球肾炎

解析：慢性肾小球肾炎的临床表现呈多样性，主要表现为血尿、蛋白尿、可伴有水肿、高血压、肾功能不全，病情迁延，肾功能逐步恶化，进入尿毒症。掌握“慢性肾小球肾炎、肾病综合征”知识点。